成釉细胞瘤各分型的病理变化不包括
A. 上皮团块中出现纤维化
B. 上皮团块中出现囊性变
C. 上皮团块中出现颗粒性变
D. 上皮团块中出现鳞状化生
E. 上皮团块中出现角化珠

正确答案：A。上皮团块中出现纤维化

解析：滤泡型：上皮岛中央的星网状区常发生囊性变。棘皮瘤型：是指肿瘤上皮岛内呈现广泛的鳞状化生，有时见角化珠形成。颗粒细胞型：肿瘤上皮细胞有时还可发生颗粒样变性。掌握“成釉细胞瘤”知识点。